观察人体对新药的耐受程度和药动学评价阶段是
A. Ⅰ期临床试验
B. Ⅱ期临床试验
C. Ⅲ期临床试验
D. Ⅳ期临床试验
E. 临床前试验

正确答案：A。Ⅰ期临床试验

解析：本题考查新药临床评价的分期。观察人体对新药的耐受程度和药动学评价阶段是Ⅰ期临床试验（A对）。Ⅱ期临床试验（B错）是治疗作用的初步评价阶段，评价药物对目标适应证患者的治疗作用和安全性。Ⅲ期临床试验（C错）是新药得到批准试生产后进行的扩大化临床试验阶段。Ⅳ期临床试验（D错）是上市后药品临床再评价阶段。临床前试验（E错）是在进行临床评价前进行的药效学、一般药理学、药动学和毒理学研究等。